为提高输液剂热压灭菌的安全系数，实际操作时，设置的F₀值一般的值的基础上增加
A. 0.3
B. 0.4
C. 0.5
D. 0.6
E. 0.7

正确答案：C。0.5

解析：本题考查的是F₀值。为提高输液剂热压灭菌的安全系数，实际操作时，设置的F₀值一般的值的基础上增加0.5（C对）。F₀值仅限于热压灭菌，生物F₀值相当于121℃热压灭菌时，杀灭容器中全部微生物所需要的时间。F₀值体现了灭菌温度与时间对灭菌效果的统一，数值更为精确、实用。为了确保灭菌效果，应适当增加安全系数，一般增加理论值的50%。